对库存商品进行循环质量抽查
A. 属于化验室工作
B. 属于物理检测室工作
C. 属于商品养护工作
D. 属于销售工作
E. 属于综合性质量管理工作

正确答案：C。属于商品养护工作

解析：本题考查药品养护。对库存商品进行循环质量抽查属于商品养护（C对）。养护人员应当根据库房条件、外部环境、药品质量特性等对药品进行养护，主要内容是：指导和督促储存人员对药品进行合理储存与作业；检查并改善储存条件、防护措施、卫生环境；对库房温湿度进行有效监测、调控；按照养护计划对库存药品的外观、包装等质量状况进行检查，并建立养护记录；对储存条件有特殊要求的或者有效期较短的品种应当进行重点养护；发现有问题的药品应当及时在计算机系统中锁定和记录，并通知质量管理部门处理；对中药材和中药饮片应当按其特性采取有效方法进行养护并记录，所采取的养护方法不得对药品造成污染；定期汇总、分析养护信息。